男，36岁。双侧颈部淋巴结肿大伴发热1周。查体：T38.4℃，颈部和右侧腹股沟区可触及数枚肿大淋巴结，最大3cm×2cm，均活动、无压痛，心肺未见异常，腹平软，肝肋下未触及，脾肋下2cm。实验室检查：Hb128g/L,WBC6.0×10⁹/L,Plt120×10⁹/L，左侧颈部淋巴结活检查可见R-S细胞。该患者应诊断为
A. 边缘区淋巴瘤
B. 滤泡性淋巴瘤
C. 套细胞淋巴瘤
D. 霍奇金淋巴瘤
E. Burkitt淋巴瘤

正确答案：D。霍奇金淋巴瘤

解析：中青年患者（青年男性为霍奇金淋巴瘤的好发人群），双侧颈部淋巴结肿大伴发热1周（霍奇金淋巴瘤临床表现），查体：T38.4℃（正常值为36℃～37℃，发热），颈部和右侧腹股沟区可触及数枚肿大淋巴结，最大3cm×2cm，均活动（霍奇金淋巴瘤首发症状），脾肋下2cm（提示脾大），实验室检查：Hb128g/L（正常值为120～160g/L），WBC6.0×10⁹/L（正常值为4～10×10⁹/L），Plt120×10⁹/L（正常值为100～300×10⁹/L），左侧颈部淋巴结活检查可见R-S细胞（霍奇金淋巴瘤的特征性病理表现），根据该患者的临床症状、体征及实验室检查，考虑患者的诊断为霍奇金淋巴瘤（D对）。霍奇金淋巴瘤主要原发于淋巴结，特点是淋巴结进行性肿大，典型的病理特征是R-S细胞存在于不同类型反应性炎症细胞的特征背景中，并伴有不同程度纤维化。边缘区淋巴瘤（A错）为B细胞来源，可伴t（11；18）。滤泡性淋巴瘤（B错）组织学特征是有滤泡存在，外套区消失，细胞形态呈小至中等大小的生发中心细胞和大的无核裂母细胞组成，来源于B细胞，CD10⁺，bcl-6⁺，bcl-2⁺，伴t（14；18）。套细胞淋巴瘤（C错）由小细胞组成的B淋巴细胞肿瘤，细胞呈CD20⁺，CD5⁺。 Burkitt淋巴瘤（E错）细胞呈CD20⁺，CD22⁺，CD5⁻。